女，30岁。G2P1。既往月经规律，月经量少。身体健康。要求长期采取避孕措施。下列哪项不是宫内节育器的作用机制
A. 直接杀灭卵子
B. 抑制卵巢排卵
C. 影响精子获能
D. 影响受精卵着床
E. 改变宫颈黏液性状

正确答案：A。直接杀灭卵子

解析：该妇女为育龄期妇女，G2P1（孕2产1），既往月经规律，月经量少。身体健康。要求长期避孕，各种避孕方法（宫内节育器、皮下埋植剂、复方口服避孕药、避孕针、阴茎套等）均适用，但首选的避孕方法是宫内节育器。宫内节育器的作用机制有：①压迫局部产生炎症反应，分泌的炎性细胞对胚胎有毒性作用。同时产生大量巨噬细胞覆盖于子宫内膜，影响受精卵着床（D对），并能吞噬精子及影响胚胎发育。②铜离子具有使精子头尾分离的毒性作用，使精子不能获能（C对）。③左炔诺孕酮IUD可使一部分妇女抑制排卵（B对），还可改变宫颈黏液性状（E对），使宫颈黏液稠厚，不利于精子穿透。可见宫内节育器的作用机制不包括直接杀灭卵子（A错，为本题正确答案）。